生物标志物是
A. 暴露剂量的指示物
B. 有害效应的指示物
C. 与发病机制有关联的一系列关键事件的指示物
D. 人群易感性的指示物
E. 细胞和分子水平上改变的指示物

正确答案：C。与发病机制有关联的一系列关键事件的指示物

解析：本题考查生物标志。生物标志是生物体内发生的与发病机制有关联的关键事件的指示物（C对ABDE错），是机体由于接触各种环境因子所引起机体器官、细胞、亚细胞的生化、生理、免疫和遗传等任何可测定的改变。